×3cm大小包块，质中等，边界不清，轻触痛。下列最适宜的检查是
A. 下腹部钡剂造影
B. 结肠镜
C. 腹部CT检查
D. 粪常规及病原学检查
E. γ-细胞毒释放检查

正确答案：B。结肠镜

解析：青年男性患者，低热，右下腹疼痛，体重减轻，腹胀，便秘，乏力（肠结核的表现）。查体可见右腹可触及5cm ×3cm大小包块，质中等，边界不清，轻触痛（肠结核的体征），故患者考虑诊断为肠结核，为了尽早确诊首选检查为结肠镜（B对A错）。腹部CT一般用于实质脏器检查（C错）。粪常规及病原学检查一般用于肠阿米巴病检查（D错）。γ-细胞毒释放检查一般用于检查肺结核，不作为肠结核首选检查（E错）。